患儿，男性，2岁，右侧完全性腭裂拟行腭裂修复术。术后出现腭瘘的原因，最常见的是
A. 患儿年龄过小
B. 手术时间过长
C. 黏骨膜瓣松弛不够，缝合时张力过大
D. 手术中未给予抗生素
E. 术后拆线时间过晚

正确答案：C。黏骨膜瓣松弛不够，缝合时张力过大

解析：本题考查腭裂修复术的术后并发症-腭瘘。患儿，男性，2岁，右侧完全性腭裂拟行腭裂修复术。术后出现腭瘘的原因，最常见的是黏骨膜瓣松弛不够，缝合时张力过大（C对）。腭瘘指腭裂修复术后仍遗留或再裂开在硬、软腭部或口腔前庭部的瘘孔，表现为口鼻腔相通，为腭裂术后最常见的并发症。腭裂术后发生腭瘘的原因很多，包括腭裂的类型，畸形的程度，腭裂手术年龄，腭裂术式的选择，手术操作，术后出血和感染，术后护理以及术后喂养等方面。但最主要的还是，在手术过程中对两侧黏骨膜瓣松弛不够，缝合时张力过大，或存在张力，当患者清醒后，吞咽及发音时肌肉张力进一步增加而影响伤口的愈合。